青春期生殖功能成熟的标志是
A. 乳腺发育
B. 月经来潮
C. 女性体态
D. 阴毛出现
E. 声音高尖

正确答案：B。月经来潮

解析：本题考查青春期生殖功能成熟的标志。少女出现第一次生理性子宫出血时称为月经来潮（B对ACDE错），是青春期生殖功能成熟的标志。